乳前牙邻面龋一般在幼儿几岁之前多见
A. 1岁
B. 2岁
C. 3岁
D. 4岁
E. 5岁

正确答案：C。3岁

解析：本题考查龋病的临床表现与分类。3岁以前（C对）的幼儿多在前牙邻面患龋，与饮食有关。各年龄段的乳牙龋病发生部位有明显的特点。1～2岁时（即3岁以前），主要发生于上颌乳前牙的唇面和邻面；3～4岁时，多发的是乳磨牙牙合面的窝沟；4～5岁时，好发于乳磨牙的邻面。